下列属于概率抽样的方法是
A. 分层抽样
B. 定额抽样
C. 偶遇抽样
D. 立意抽样
E. 雪球抽样

正确答案：A。分层抽样